义齿初戴时，给患者的医嘱中错误的是
A. 会有异物感、发音不清等，要坚持戴用
B. 先进食小块软食
C. 避免咬硬物
D. 可能有疼痛，要坚持戴用
E. 尽量用两侧后牙同时咀嚼

正确答案：D。可能有疼痛，要坚持戴用

解析：本题考查给患者的戴牙指导。戴用义齿出现疼痛（D错，为本题的正确答案），可能是由于组织面不适，基托边缘过长，义齿不稳定等原因造成的，若不及时就医处理，会导致口腔黏膜进一步损伤，甚至导致牙槽嵴吸收的严重后果。全口义齿初戴时出现异物感和发音不清等问题（A对），多由于初戴义齿不适应导致的，应嘱患者坚持戴用义齿，适应一段时间会有明显改善。口腔条件差，适应能力差而又有不良咬合习惯的患者，不易过早戴用义齿咀嚼食物，适应一段时间后，先吃软的小块食物（B对），用两侧后牙咀嚼食物（E对），再逐渐吃一般食物（C对）以保护口腔组织健康。